结合上皮的组织来源为
A. 缩余釉上皮
B. Malassez上皮剩余
C. 上皮根鞘
D. 牙乳头
E. 牙囊

正确答案：A。缩余釉上皮

解析：当釉质发育完成后，成釉细胞、中间层细胞和星网状层与外釉上皮细胞结合，形成缩余釉上皮。当牙齿萌出到口腔，缩余釉上皮在牙颈部形成牙龈的结合上皮。掌握“牙体、牙周组织的形成”知识点。